粉尘进入肺内，下列哪一型细胞防御作用最突出
A. 淋巴细胞
B. 白细胞
C. 成纤维细胞
D. 巨噬细胞
E. 浆细胞

正确答案：D。巨噬细胞

解析：本题考查巨噬细胞对粉尘的吞噬作用。进入肺泡的粉尘黏附在肺泡腔表面，被肺泡巨噬细胞（D对ABCE错）吞噬，形成尘细胞。大部分尘细胞通过自身阿米巴样运动及肺泡的舒张转移至纤毛上皮表面，再通过纤毛运动而清除。小部分尘细胞因粉尘作用受损、坏死、崩解，尘粒游离后再被巨噬细胞吞噬，如此循环往复。